因富含鞣质，与乳酶生等含酶制剂联用时会产生抑酶作用的中药有
A. 诃子
B. 麻黄
C. 女贞子
D. 地榆
E. 山茱萸

正确答案：A、D、E。诃子；地榆；山茱萸

解析：本题考查的是中西药联用的药物相互作用。因富含鞣质，与乳酶生等含酶制剂联用时会产生抑酶作用的中药有诃子（A对）、地榆（D对）与山茱萸（E对）。富含鞣质的中药大黄、山茱萸、诃子、五倍子、地榆、石榴皮、虎杖、侧柏叶等，在与淀粉酶、蛋白酶、胰酶、乳酶生等含酶制剂联用时，可与酶的酰胺键或肽键结合形成牢固的氢键缔合物，使酶的效价降低，影响药物的代谢。麻黄（B错）含生物碱，可抑制胃蠕动及排空，延长红霉素、洋地黄类强心苷药物在胃内的滞留时间，或使红霉素被胃酸破坏而降低疗效或使强心苷类药物在胃肠道内的吸收增加，引起洋地黄类药物中毒。女贞子（C错）含有机酸成分，与一些碱性药物如氢氧化铝、氢氧化钙、碳酸钙、枸橼酸镁、碳酸氢钠、氨茶碱、氨基糖苷类抗生素等合用时，会发生酸碱中和而降低或失去药效。